医院获得性肺炎中，病原体进入肺组织引发肺炎最主要的途径是
A. 飞沫（气溶胶）吸入
B. 血源性播散
C. 胃食管反流物误吸
D. 口咽部分泌物吸入
E. 污染空气吸入

正确答案：C。胃食管反流物误吸

解析：医院获得性肺炎则更多是通过误吸胃肠道的定植菌（胃食管反流）和（或）通过人工气道吸入环境中的致病菌引起（C对）。50%～70%的健康人睡眠时可有口咽部分泌物吸入下呼吸道，吞咽和咳嗽反射减弱或消失者如老年、意识障碍、食管疾病、气管插管、胃排空延迟及张力降低者更易发生误吸。SARS的传播途径主要为近距离飞沫传播（A错）。血源性播散（B错）较少引起医院获得性肺炎（HAP），HAP见于机体免疫低下、严重腹腔感染等易于发生菌血症的患者。污染空气吸入（E错）是引起的HAP的途径，但并不是最主要的感染途径。